凝血因子和血小板生成超过消耗的情况可见于
A. 轻度DIC
B. DIC早期
C. 慢性DIC
D. DIC晚期
E. 急性DIC

正确答案：C。慢性DIC

解析：凝血因子和血小板生成超过消耗的情况可见于慢性DIC（C对ABDE错）。机体代偿功能较好，凝血因子和血小板代偿性生成迅速，甚至超过消耗，可出现纤维蛋白原等暂时性升高，出血或血栓形成症状不明显。常见于慢性DIC 或恢复期DIC, 也可转为失代偿型 DIC。